矍麦除利尿通淋外，又能
A. 破血通经
B. 攻毒杀虫
C. 祛风止痛
D. 清心除烦
E. 消肿散结

正确答案：A。破血通经

解析：本题考查的是瞿麦的功效。矍麦除利尿通淋外，又能破血通经（A对）。瞿麦：【功效】利尿通淋，破血通经。露蜂房：【功效】攻毒杀虫（B错），祛风止痛（C错）。灯心草：【功效】利尿通淋，清心除烦（D错）。连翘：【功效】清热解毒，疏散风热，消肿散结（E错），利尿。